依据《药品广告审查标准》规定，可以发布广告的药品是
A. 麻醉药品、精神药品
B. 治疗肿瘤、艾滋病的药品
C. 毒性药品、放射性药品
D. 治疗感冒药品
E. 防疫制品

正确答案：D。治疗感冒药品

解析：本题考查可以发布广告的药品。依据《药品广告审查标准》规定，可以发布广告的药品是治疗感冒药品（D对）。按照规定，不得做广告的产品包括：①麻醉药品、精神药品、医疗用毒性药品、放射性药品、药品类易制毒化学品，以及戒毒治疗的药品、医疗器械；②军队特需药品、军队医疗机构配制的制剂；③医疗机构配制的制剂；④依法停止或者禁止生产、销售或者使用的药品、医疗器械、保健食品和特殊医学用途配方食品；⑤法律、行政法规禁止发布广告的情形；⑥批准试生产的药品。